变异型心绞痛，不宜使用
A. 硝酸甘油软膏
B. 硝酸甘油贴片
C. 普萘洛尔
D. 硝苯地平
E. 地尔硫草

正确答案：C。普萘洛尔

解析：变异性心绞痛由冠状动脉痉挛引起，也常与动脉粥样硬化性疾病有关。普萘洛尔第十版药理学（C错，为本题正确答案）主要用于稳定性心绞痛，疗效较好，可减少发作次数，对兼有高血压或心律失常患者更为适用，但能引起冠状动脉收缩，不宜用于变异型心绞痛。硝酸甘油可直接松弛血管平滑肌，降低心肌耗氧，增加缺血区血流供应，对各型心绞痛均有作用，舌下含服1-2分钟起效，作用时间持续30分钟，硝酸甘油软膏（A对）和硝酸甘油贴片（B对）可以获得更持久的作用。硝苯地平（心痛定）（D对）属于二氢吡啶类，扩张冠脉作用强，可解除冠脉痉挛，对变异性心绞痛效果好。地尔硫草（E对）作用强度介于硝苯地平与维拉帕米之间，能选择性扩张冠状血管，主要用于治疗冠状动脉痉挛引起的变异型心绞痛，以及不稳定型心绞痛。